男，30岁，四肢、躯干重度烧伤，6天后高热、谵妄，周身皮疹，创面有较多黄稠脓性分泌物。该病人经血检查及培养，上述诊断成立，此时应如何处理
A. 加大已应用的广谱抗生素量
B. 输血抗休克治疗
C. 药物降温
D. 停止使用原广谱抗生素，改用抗真菌药物
E. 人工冬眠治疗

正确答案：D。停止使用原广谱抗生素，改用抗真菌药物

解析：如果真菌培养试验阳性结果，应该全身应用抗真菌药物进行治疗。掌握“外科感染”知识点。